下列哪种前列腺素属发热介质？
A. PGA2
B. PGD2
C. PGE2
D. PGl2
E. PGF2

正确答案：C。PGE2

解析：前列腺素E2（PGE2）（C对）是一种重要的细胞生长和调节因子，是前列腺素的一种，其作用为扩张血管，增加器官血流量，降低血管外周阻力，降低血压，使支气管平滑肌舒张，降低通气阻力。另外据研究发现，脑室内注射PGE或微注射法将PGE2注入POAH区会导致发热。